阑尾残株炎所致的肠梗阻是
A. 动力性肠梗阻
B. 粘连性肠梗阻
C. 单纯性肠梗阻
D. 肠扭转
E. 粪石梗阻

正确答案：B。粘连性肠梗阻

解析：阑尾残株炎是指阑尾切除时阑尾残端保留过长，术后残株炎症复发。残株炎症反复发作，大量纤维素渗出并沉积在浆膜面上形成一网状物，纤维网使邻近的浆膜面黏合在一起，之后成纤维细胞出现在其中并分泌胶原纤维，最终形成肠粘连，引发肠梗阻。因此阑尾残株炎所致的肠梗阻是粘连性肠梗阻（B对）。粘连性肠梗阻既可表现为单纯性肠梗阻，也可表现为绞窄性肠梗阻（C错）。动力性肠梗阻（A错）指由于神经抑制或毒素刺激以致肠壁肌运动紊乱所致的肠梗阻。阑尾残株炎一般不会导致肠扭转和粪石梗阻（DE错）。